导致伦敦烟雾事件的污染物主要是
A. SO₂、烟尘
B. O₂、NOₓ
C. NOₓ、碳氢化合物
D. CO、O₃、NOₓ
E. CO、O₃、NO

正确答案：A。SO₂、烟尘

解析：本题考查伦敦烟雾事件的污染物。伦敦烟雾事件的污染源是家庭及工业燃煤，污染物主要是SO₂、烟尘（A对BCDE错）。